阑尾根部的体表投影位于
A. 脐与右髂前上棘连线的中、外1/3交点
B. 脐与右髂前下棘连线的中、外1/3交点
C. 两侧髂前上棘连线的中点
D. 两侧髂结节连线的中、右1/3交点
E. 无

正确答案：A。脐与右髂前上棘连线的中、外1/3交点

解析：阑尾根部的体表投影点有两种定位方式，一是脐与右髂前上棘连线中、外1/3交点(A对B错)，二是两侧髂前上棘连线的中、右1/3交点(CD错)。